有辅助臂的卡环
A. 回力
B. 倒钩
C. 联合
D. 圈形
E. 对半

正确答案：D。圈形

解析：本题考查卡环。有辅助臂的卡环为圈形卡环（D对）。圈形卡环：多用于远中孤立的磨牙上，上颌磨牙向近中颊侧倾斜、下颌磨牙向近中舌侧倾斜者。卡环臂的尖端在上颌磨牙的颊侧和下颌磨牙的舌侧。铸造的圈形卡有近、远中两个支托。远中支托有增加支持，防止基牙进一步倾斜移位作用。非倒凹一侧卡环臂有辅助臂与支架相连，可增加卡环臂的强度。回力卡环（A错）位于基牙远中的卡体和支托部分不直接与游离鞍基相连，而是在其舌侧卡臂尖处通过小连接体与义齿支架相连，具有应力中断作用，可以减小游离端缺失末端基牙所受到的扭力和负担。倒钩卡环（B错）用于倒凹区在支托的同侧下方的基牙，又称下返卡环。当有软组织倒凹区无法使用杆形卡环时选用。联合卡环（C错）：卡环是可摘局部义齿直接固位体结构，是直接卡抱在基牙上的金属部分。其主要作用为防止义齿（牙合）向脱位，亦能防止义齿下沉、旋转、移位，也起一定支撑和稳定作用。由位于相邻两基牙上的2个卡环通过共同的卡环体相连而成的叫做联合卡环，此卡环需用铸造法制作。对半卡环（E错）：由颊、舌侧两个相对的卡环臂和近、远中两个（牙合）支托所组成，以各自的小连接体分别连接于树脂基托中或铸造支架上。注意应将其中一个卡环臂设计为对抗臂，不宜将两个卡环臂都设计为固位臂。主要用于前后有缺隙、孤立的前磨牙或磨牙。